女，28岁。婚后4年未孕。月经初潮12岁，5年前起月经稀发、经量减少，近2年闭经，体重增加8kg。查体：BP120/80mmHg，BMI26。双乳有触发泌乳。最可能的诊断是
A. 垂体泌乳素瘤
B. 卵巢功能早衰
C. 希恩综合征
D. 腺垂体功能减退症
E. 多囊卵巢综合症

正确答案：A。垂体泌乳素瘤

解析：该患者为生育年龄女性，婚后4年未孕，5年前起月经稀发、经量减少，近2年闭经，双乳有触发泌乳（高催乳素血症多表现为不孕，月经少、稀发至闭经，溢乳），诊断为高催乳素血症。垂体疾病是引起高催乳素血症最常见的原因，以垂体催乳素瘤（A对）最常见。卵巢功能早衰（P354）（B错）是指40岁前，由于卵巢内卵泡耗竭或医源性损伤发生卵巢功能衰竭，表现为继发性闭经，常伴围绝经期症状，不会出现泌乳的临床表现。希恩综合征（P354）（C错）由于产后大出血休克，导致腺垂体促性腺激素分泌细胞缺血坏死，引起腺垂体功能低下（GnRH和PRL分泌均下降）而出现闭经、无泌乳、基础代谢率降低等症状。腺垂体功能减退症（D错）症状与希恩综合征类似。多囊卵巢综合症（P359）（E错）以高雄激素、持续无排卵、卵巢多囊改变为特征，常伴有胰岛素抵抗和肥胖，无泌乳。